研究所研究员李某承担了为大型油轮设计汽笛的任务，因为条件特殊，要求汽笛发出的声音传播得尽可能远一些，这种情况需要使用
A. 高频声
B. 中频声
C. 低频声
D. 混频声
E. 宽频声

正确答案：C。低频声